属于食品安全部门规章的是
A. 《中华人民共和国食品安全法》
B. 《国务院关于加强食品等产品安全监督管理的特别规定》
C. 《保健食品注册与备案管理办法》
D. 《北京市食品安全条例》
E. 《重庆市食品安全管理办法》

正确答案：C。《保健食品注册与备案管理办法》

解析：本题考查食品安全部门规章。食品安全部门规章指国务院各部门根据法律和国务院的行政法规，在本部门的权限内制定的规定、办法实施细则、规则等规范性文件。如国家食品药品监督管理总局制定的《保健食品注册与备案管理办法》（2016）（C对ABDE错）。